以下对糖尿病检验结果的解释正确的是
A. 尿糖阴性可以排除糖尿病
B. 尿糖阳性可以诊断为糖尿病
C. 尿酮阳性仅见于糖尿病
D. 空腹血糖正常可以排除糖尿病
E. 餐后2小时血糖正常可以是糖尿病

正确答案：E。餐后2小时血糖正常可以是糖尿病

解析：糖尿病尿糖阳性只提示血糖超过肾糖阈，尿糖阴性不能排除糖尿病（A错），并发肾脏病变肾小球滤过率下降时，肾糖阈升高，血糖达糖尿病标准，尿糖仍可阴性。同样，尿糖阳性也不能确诊糖尿病（B错），肾小管重吸收功能减退时，原尿中葡萄糖重吸收减少，此时血糖位于正常范围，尿糖仍可阳性。糖尿病可出现尿酮体阳性（C错），但尿酮体阳性不仅见于糖尿病，长期饥饿、肝硬化等因糖代谢障碍，也可能出现尿酮阳性。诊断糖尿病的指标有空腹血糖≥7.0mmol/L、糖尿病症状加随机血糖≥11.1 mmol/L或餐后2小时血糖≥11.1mmol/L。这三项指标中，只要其中一项或两项达标，即可确诊糖尿病，因此空腹血糖正常不能排除糖尿病（D错），餐后2小时血糖正常也可是糖尿病（E对）。